女性，70岁，无牙颌。戴用全口义齿1周，自诉义齿固位差，易脱落。如果患者说明仅在大张口时易掉，应该检查
A. 基托边缘伸展
B. 义齿磨光面形态
C. 前牙覆（牙合）、覆盖
D. 侧方（牙合）平衡
E. 正中（牙合）平衡

正确答案：A。基托边缘伸展

解析：当口腔处于休息状态时，义齿固位尚好，但张口、说话、打哈欠时义齿易脱位，这是由于基托边缘过长、过厚；唇、颊、舌系带区基托边缘缓冲不够，影响系带活动；人工牙排列的位置不当，排列在牙槽嵴顶的唇颊或舌侧，影响周围肌肉的活动；义齿磨光面外形不好等造成的。应磨改基托过长或过厚的边缘，缓冲系带部位的基托，形成基托磨光面应有的外形，或适当磨去部分人工牙的颊舌面，减小牙齿的宽度。掌握“全口义齿戴入后问题及处理”知识点。